（）教授是我国职业医学的先驱者和奠基人
A. 吴执中
B. 吴阶平
C. 何凤生
D. 周恒铎

正确答案：A。吴执中

解析：本题考查职业医学的发展史。1954年，我国开始建立劳动卫生与职业病的防治机构。杰出的内科专家吴执中（A对BCD错）教授在实践的基础上主编了《职业病》一书，他是我国职业病学的先驱者和奠基人。